生殖健康的定义
A. 母子保健
B. 没有疾病
C. 虚弱
D. 在生命所有各阶段的生殖功能和生命全过程中，身体、心理和社会适应的完好状态，而不仅仅是没有疾病和虚弱
E. 生育健康的下一代

正确答案：D。在生命所有各阶段的生殖功能和生命全过程中，身体、心理和社会适应的完好状态，而不仅仅是没有疾病和虚弱

解析：本题考查生殖健康的定义。WHO根据健康的定义给予生殖健康的定义为：在生命所有阶段的生殖功能和过程中的身体、心理和社会适应的完好状态，而不仅仅是没有疾病和虚弱（D对ABCE错）。